8个月男婴，咳嗽3天，发热伴气促1天，查体：呼吸急促，口周略发青，咽部充血，双肺闻及中小水泡音，心腹（-）：白细胞10×10⁹/L，N0.65，L0.35，其最可能的诊断是
A. 支气管炎
B. 支气管哮喘
C. 原发性肺结核
D. 支气管肺炎
E. 毛细支气管炎

正确答案：D。支气管肺炎

解析：支气管炎（A错）大多先有上呼吸道感染的症状，之后以咳嗽为主要症状…一般无全身症状。双肺呼吸音粗糙，可有不固定的散在干啰音和粗中湿啰音。支气管哮喘（B错）表现为咳嗽和喘息阵发性发作，以夜间和清晨为重。原发性肺结核（C错）症状轻重不一，轻者可无症状，一般起病缓慢，可有低热、食欲不振、疲乏、盗汗等结核中毒症状，多见于年龄较大的儿童。支气管肺炎（D对）起病多较急，发病数日前多先有上呼吸道感染，主要临床表现为发热、咳嗽、气促、肺部固定中细湿啰音，细菌性肺炎白细胞计数升高，中性粒细胞增多。毛细支气管炎（E错）喘息和哮鸣音为其突出表现，主要表现为下呼吸道梗阻症状…严重发作者，可见面色苍白、烦躁不安，口周和口唇发绀，全身中毒症状较轻，少见高热。